主产于四川的中药材有
A. 黄连
B. 附子
C. 天麻
D. 牛膝
E. 甘草

正确答案：A、B。黄连；附子